崩解剂
A. 羧甲基淀粉钠
B. 硬脂酸镁
C. 乳糖
D. 羟丙基甲基纤维素溶液
E. 水

正确答案：A。羧甲基淀粉钠

解析：本题考查片剂的常用辅料。崩解剂系指促使片剂在胃肠液中迅速破裂成细小颗粒的辅料。常用的崩解剂有：干淀粉、羧甲基淀粉钠（CMS-Na）（A对）、低取代羟丙基纤维素、交联羧甲基纤维素钠（CCMC-Na）、交联聚维酮（PVPP）和泡腾崩解剂（碳酸氢钠和枸橼酸组成的混合物，也可以用柠檬酸、富马酸与碳酸钠、碳酸钾、碳酸氢钾）等。硬脂酸镁（B错）为润滑剂。乳糖（C错）为稀释剂。羟丙基甲基纤维素溶液（D错）为黏合剂。蒸馏水（E错）为润湿剂。